“挂甲”的药材是
A. 海金沙
B. 冰片
C. 蜂蜜
D. 麝香
E. 天然牛黄

正确答案：E。天然牛黄

解析：本题考查的是药材天然牛黄的性状特征。“挂甲”的药材是天然牛黄（E对）的性状特征。一些传统经验鉴别方法仍是鉴别动物类中药有效而重要的手段：手试法，如毛壳麝香（D错）手捏有弹性；麝香仁以水润湿，手搓能成团，轻揉即散，不应粘手、染手、顶指或结块。水试法，熊胆仁投于水杯中，即在水面旋转并呈现黄线下降而不扩散；牛黄水液可使指甲染黄，习称“挂甲”；火试法，如麝香仁撒于炽热坩埚中灼烧，初则迸裂，随即熔化膨胀起泡，浓香四溢，灰化后呈白色灰烬，无毛、肉焦臭，无火焰或火星；马宝粉末置于锡箔纸上加热，其粉末聚集，并发出马尿臭等。海金沙（A错）火烧有爆鸣声且有闪光。冰片（B错）点燃发生浓烟，并有带光的火焰。蜂蜜（C错）放久或遇冷渐有白色颗粒状结晶析出。